幼儿园与低年级小学生的视力低下多属于
A. 视力低下
B. 近视
C. 远视
D. 散光
E. 弱视

正确答案：B。近视